对已造成食物中毒事故或者有证据证明可能导致食物中毒事故的，可以对该食品生产经营者采取临时控制措施的部门是
A. 县级以上地方人民政府卫生行政部门
B. 省级地方人民政府卫生行政部门
C. 县级以上地方人民政府
D. 省级地方人民政府
E. 国务院卫生行政主管部门

正确答案：A。县级以上地方人民政府卫生行政部门